一青年近3日咳嗽，高烧39℃，铁锈色痰，WBC18.5×109/L，X线胸片发现右肺中叶有大片阴影，临床诊断为大叶性肺炎，请问致病菌是哪种
A. 嗜肺军团菌
B. 肺炎链球菌
C. 肺炎克雷伯菌
D. 肺炎支原体
E. 肺炎衣原体

正确答案：B。肺炎链球菌

解析：肺炎链球菌所致疾病主要为大叶性肺炎，其次为支气管炎。掌握“链球菌属”知识点。